迷走神经经过下列何解剖结构
A. 食管裂孔
B. 主动脉裂孔
C. 腔静脉孔
D. 枕骨大孔
E. 无

正确答案：A。食管裂孔

解析：迷走神经经过食管裂孔（A对）。